中国营养学会确定的全民营养周的时间为
A. 每年5月的第一周
B. 每年5月的第三周
C. 每年5月的第四周
D. 每年3月的第一周
E. 每年3月的第三周

正确答案：B。每年5月的第三周

解析：本题考查中国营养学会确定的全民营养周的时间。中国营养学会2014年确定每年5月的第三周（B对ACDE错）为全民营养周。